关于砷致畸致癌、致突变作用的描述，不正确的是
A. 尚未见到砷对人致畸胎流行病学调查报道
B. 短期体外筛检实验证明砷具较强致突变作用
C. 砷致人类癌症的理论基础是体细胞突变学说
D. 动物实验结果显示砷具有致癌作用
E. IARC已将砷定为确认致癌物

正确答案：D。动物实验结果显示砷具有致癌作用

解析：本题考查砷的致癌、致畸作用。砷的致癌作用已成定论，国际癌症研究机构已于1987年将其确定为致癌物（E对）。人群流行病学调查资料显示，砷能引起人类的许多脏器癌瘤（D错，为本题正确答案），以不同方式接触不同形式的珅砷可诱发皮肤癌、乳腺癌、肾癌、膀胱癌、淋巴肉瘤、血管肉瘤、口腔癌、骨癌、腹膜及生殖系统肿瘤等。砷致人类癌症的理论基础是体细胞突变学说（C对）。短期体外筛检实验证明砷具较强致突变作用（B对）。动物实验证实，三氧化二砷、砷酸钠、亚砷酸钠等物质具有较强致畸作用。尚未见到砷对人致畸胎流行病学调查报道（A对）。